舍格伦综合征属于
A. 传染性疾病
B. 遗传性疾病
C. 自身免疫性疾病
D. 由病毒引起的疾病
E. 生理功能紊乱性疾病

正确答案：C。自身免疫性疾病

解析：舍格伦综合征是一种自身免疫性疾病，其特征表现为外分泌腺的进行性破坏，导致黏膜及结膜干燥，并伴有各种自身免疫性病征。掌握“舍格伦综合征”知识点。